可激动γ-氨基丁酸（GABA）受体和钠通道，属于苯二氮䓬类抗癫痫药的是
A. 卡马西平
B. 苯妥英钠
C. 丙戊酸钠
D. 苯巴比妥
E. 氯硝西泮

正确答案：E。氯硝西泮

解析：本题考查苯二氮䓬类抗癫痫药。氯硝西泮（E对）可激动γ-氨基丁酸（GABA）受体和钠通道，属于苯二氮䓬类抗癫痫药；卡马西平（A错）主要阻滞电压依赖性的钠通道，属于二苯并氮䓬类抗癫痫药；苯妥英钠（B错）属于乙内酰脲类抗癫痫药，可通过减少钠离子内流而使神经细胞膜稳定；丙戊酸钠（C错）为脂肪酸类抗癫痫药，其作用机制为抑制γ-氨基丁酸（GABA）；苯巴比妥（D错）属于巴比妥类抗癫痫药，作用机制为增强γ-氨基丁酸A型受体活性。